儿童风湿热的相关发病机制是
A. 链球菌直接损害
B. Ⅲ型变态反应
C. Ⅳ型变态反应
D. Ⅰ型变态反应
E. 肠球菌的毒素作用

正确答案：B。Ⅲ型变态反应

解析：风湿热（RF）是一种由咽喉部感染A组乙型溶血性链球菌后反复发作的急性或慢性风湿性疾病，主要累及关节、心脏、皮肤和皮下组织，偶可累及中枢神经系统、血管、浆膜及肺、肾等内脏。主要发病机制为：A组乙型溶血性链球菌的抗原性很复杂，各种抗原分子结构与机体器官抗原存在同源，机体的抗链球菌免疫反应可与人体组织产生免疫交叉反应，导致器官损害。正好符合Ⅲ型变态反应的机制（B对）。